作用于DNA拓异构酶Ⅰ的药物是
A. 喜树碱
B. 硫酸长春碱
C. 多柔比星
D. 紫杉醇
E. 盐酸阿糖胞苷

正确答案：A。喜树碱

解析：本题考查喜树碱。作用于DNA拓朴异构酶Ⅰ的药物是喜树碱（A对）。拓扑异构酶Ⅰ抑制剂的代表药有伊立替康、拓扑替康、羟喜树碱。硫酸长春碱（B错）、紫杉醇（D错）为微管蛋白活性抑制剂。多柔比星（C错）为DNA嵌入剂。盐酸阿糖胞苷（E错）为DNA多聚酶抑制剂。